微血管病性溶血性贫血的发病机制主要与下列哪项因素有关？
A. 微血管内皮细胞大量受损
B. 纤维蛋白丝在微血管腔内形成细网
C. 血小板的损伤
D. 小血管内血流淤滞
E. 白细胞的破坏作用

正确答案：B。纤维蛋白丝在微血管腔内形成细网

解析：纤维蛋白丝在微血管腔内形成细网（B对）是微血管病性溶血性贫血的主要发病机制。当血流中的红细胞通过网孔时，被黏着、滞留或挂在纤维蛋白丝上，然后这些红细胞在血流不断的冲击下发生破裂，患者外周血涂片中可见一些特殊的形态各异的红细胞，其外形呈盔形、星形、新月形等，统称为裂体细胞或红细胞碎片。微血管内皮细胞大量受损（A错），可使纤溶酶原激活物释放增多，从而激活纤溶系统，导致大储纤溶酶生成。小血管内血流淤滞（D错）是休克等原因导致微循环严重障碍。白细胞的破坏作用（E错），释放组织因子样物质，激活外源性凝血系统，启动凝血，促进DIC的发生。